关于白假丝酵母菌的特点，哪项错误
A. 属条件致病菌
B. 培养呈类酵母型菌落
C. 可引起皮肤和黏膜感染
D. 可引起全身脏器感染
E. 对青霉素、链霉素敏感

正确答案：E。对青霉素、链霉素敏感